在膜剂处方中，除主药和成膜材料外，还包括
A. 着色剂
B. 脱膜剂
C. 增塑剂
D. 表面活性剂
E. 填充剂

正确答案：A、B、C、D、E。着色剂；脱膜剂；增塑剂；表面活性剂；填充剂

解析：本题考查膜剂。膜剂处方中，除主药和成膜材料外，还有增塑剂（C对）、脱膜剂（B对）、着色剂（A对）、表面活性剂（D对）、填充剂（E对）。